身体活动中或活动后发生的最常见的运动伤害是
A. 脑出血
B. 外伤和急性心血管疾病
C. 癫痫
D. 肠梗阻
E. 阑尾炎

正确答案：B。外伤和急性心血管疾病

解析：运动伤害，是指身体活动中或活动后发生的疾病，最常见的是外伤和急性心血管事件。掌握“身体活动促进”知识点。